肯氏一类牙列缺损，如果口底至舌侧龈缘的距离为5mm，大连接体应该采用
A. 舌杆
B. 舌板
C. 唇杆
D. 舌杆+连续卡环
E. 前牙舌隆突上连续卡环

正确答案：B。舌板

解析：舌板：舌板是金属铸成的舌基托，为舌杆上缘向上延伸，覆盖至下前牙的舌隆突区。用于口底浅，舌侧软组织附着高（口底到龈缘的距离在7mm以下）。特别适用于以下情况：前牙松动需用夹板固定者；舌系带附着过高或舌面间隙不能容纳舌杆者；舌侧倒凹过大不宜用舌杆者。掌握“局部义齿连接体”知识点。